雄性动物一般情况下对毒物的代谢降解作用比雌性动物强，是由于
A. 新生或幼年鼠毒物的反应灵敏，而对需经代谢活化的毒物不敏感
B. 老年动物对毒物的反应不灵敏
C. 雄性动物比雌性动物对某些有机磷农药反应灵敏
D. 雄性激素促进某些酶的活性
E. 生理和营养状况与毒效应有关

正确答案：D。雄性激素促进某些酶的活性